神分属于五脏，肝藏
A. 神
B. 魂
C. 意
D. 魄
E. 志

正确答案：B。魂

解析：魂为随神气而往来的精神活动，寄居于血，肝藏血，故藏魂（B对）；神是依存先天之精生成而表现于外的生命活动，寄居于脉，心藏脉（A错）；意是获得感性印象，形成的记忆、意念，寄居于营，脾藏营（C错）；魄是与生俱来的、本能的感知觉和运动能力，寄居于气，肺藏气（D错）；志是在意的基础上，形成理性的意志、志向等的神志活动，寄居于精，肾藏精（E错）。